温经汤的君药是
A. 当归、川芎
B. 当归、肉桂
C. 当归、吴茱萸
D. 吴茱萸、桂枝
E. 当归、桂枝

正确答案：D。吴茱萸、桂枝

解析：该题考查温经汤的方解。温经汤功能温经散寒，养血祛瘀，主治冲任虚寒，瘀血阻滞证。方中吴茱萸、桂枝温经散寒，通利血脉，其中吴茱萸功擅散寒止痛，桂枝长于温痛血脉，共为君药（D对）。趣记：趣记：熊皮贵，无人要，冬将夏，草当浇（川芎 牡丹皮 桂枝 吴茱萸 人参 芍药 麦冬 生姜 半夏 甘草 当归 阿胶）。